在《中国药典》中，维生素K₁的含量测定方法是
A. 碘量法
B. 非水溶液滴定法
C. 旋光度法
D. 气相色谱法
E. 高效液相色谱法

正确答案：E。高效液相色谱法

解析：本题考查维生素K₁的含量测定方法。在《中国药典》中，维生素K₁的含量测定方法是高效液相色谱法（E对）。